针对可能发生的突发事件，在风险分析与评估的基础上，预先制定的应急计划与行动方案，应被规范地称之为
A. 应急响应
B. 应急管理
C. 应急预案
D. 应急监督
E. 应急反应

正确答案：C。应急预案

解析：本题考查应急预案。应急预案（C对ABDE错）是针对可能发生的突发事件，在风险分析与评估的基础上预先制定的应急计划与行动方案。